一年级200人，12岁患龋率20%，龋均1。二年级200人，13岁患龋率22.5%，龋均1.5。三年级100人，14岁患龋率25%，龋均2。全年级患龋率
A. 14%
B. 20%
C. 22%
D. 22.5%
E. 25%

正确答案：C。22%

解析：本题考查患龋率的计算。一年级200人，12岁患龋率20%，龋均1。二年级200人，13岁患龋率22.5%，龋均1.5。三年级100人，14岁患龋率25%，龋均2。患龋率=患龋病人数/受检人数xl00%，一年级患龋人数为40；二年级患龋人数45；三年级患龋人数为25。因此本题全年级患龋率=（40+45+25）/（200+200+100）xl00%=22%（C对）。